Kennedy第一类牙列缺损者
A. 为单侧游离缺失
B. 为双侧游离缺失
C. 为非游离缺失
D. 为间隔缺失
E. 为前牙缺失

正确答案：B。为双侧游离缺失

解析：本题考查Kennedy牙列缺损分类。Kennedy第一分类指双侧后牙游离端缺失（B对）。单侧游离缺失（A错）属于第二类。牙弓单侧后牙非远中游离缺失（C错）属于第三类。过中线的前牙缺失（E错）属于第四类。间隔缺失（D错）不属于Kennedy分类的的范围。